目前国内最常见的细菌性痢疾病原菌是
A. 志贺菌群
B. 福氏菌群
C. 鲍氏菌群
D. 宋内菌群
E. 舒氏菌群

正确答案：B。福氏菌群

解析：根据菌体抗原结构及生化反应的不同，可将痢疾杆菌分为四群：A群（志贺菌群）、B群（福氏菌群）、C群（鲍氏菌群）和D群（宋内菌群）目前发达国家以D群为主，我国以B群为主。掌握“细菌性痢疾”知识点。